心尖区闻及隆隆样舒张期杂音，考虑为
A. 二尖瓣关闭不全
B. 主动脉瓣关闭不全
C. 二尖瓣狭窄
D. 肺动脉瓣狭窄
E. 三尖瓣狭窄

正确答案：C。二尖瓣狭窄

解析：心尖区闻及隆隆样舒张期杂音，考虑为二尖瓣狭窄（C对）。二尖瓣关闭不全（P292）（A错）的典型杂音为心尖区全收缩期吹风样杂音。主动脉瓣关闭不全（P299）（B错）的典型杂音为主动脉瓣区舒张期高调递减叹气样杂音。肺动脉瓣狭窄（P275）（D错）的典型杂音为胸骨左缘第二肋间响亮的收缩期喷射性杂音。三尖瓣狭窄（E错）的典型杂音为胸骨左缘第4肋间收缩期前或舒张期滚筒样杂音。